在一定pH条件下，分子在SDS-聚丙烯酰胺凝胶电泳中，决定其迁移速度的主要因素是
A. 分子形状
B. 分子电荷
C. 分子极性
D. 分子量大小
E. 分子溶解度大小

正确答案：D。分子量大小

解析：SDS-聚丙烯酰胺凝胶电泳分离蛋白质，若蛋白质样品和聚丙烯酰胺凝胶系统中加入带负电荷较多的十二烷基硫酸钠（SDS），使所有蛋白质颗粒表面覆盖一层 SDS分子，导致蛋白质分子间的电荷差异消失，此时蛋白质在电场中的泳动速率仅与蛋白质颗粒大小（D对ABCE错）有关，所以决定其迁移速度的主要因素为分子量的大小。